经过口服抗原导致全身免疫耐受的是
A. SIgA
B. IgG
C. IgE
D. IgM
E. IgD

正确答案：A。SIgA